CO中毒造成缺氧的原因为：
A. O2与HHb结合速率减慢
B. HbO2解离速度增加
C. HbCO无携氧能力
D. CO使RBC内2,3-DPG增高
E. 以上都不对

正确答案：C。HbCO无携氧能力

解析：一氧化碳可与血红蛋白结合形成碳氧血红蛋白（HbCO）使其失去携氧能力（C对）。CO与Hb的亲和力是氧的210倍（A错），当吸入气中含有0.1%的CO时，约有50%的血红蛋白与之结合形成HbCO。同时CO还可抑制RBC内糖酵解，使2，3-DPG减少（D错），氧离曲线左移，HbO2解离速度降低（B错）。